患儿，4岁。发热，呕吐5小时入院，神志不清，口唇发绀。对诊断流行性脑脊髓膜炎有帮助的临床表现是
A. 口唇疱疹
B. 脑膜刺激征
C. 皮肤瘀点瘀斑
D. 反复惊厥
E. 抽搐，昏迷

正确答案：C。皮肤瘀点瘀斑

解析：流行性脑脊髓膜炎是由脑膜炎奈瑟菌引起的急性化脓性脑膜炎，是化脓性脑膜炎的一种。70%患者会出现皮肤瘀点瘀斑（C对）。口唇疱疹（A错）、脑膜刺激征（B错）、反复惊厥（D错）、抽搐，昏迷（E错）等表现均缺乏特异性。